患者，女，60岁。肺心病史，咳喘加重1周，神志恍惚，谵语，烦躁不安，嗜睡，颜面发绀，舌紫暗，舌苔白腻，脉滑数。动脉血气分析：PaO₂50mmHg，PaCO₂55mmHg。其诊断是
A. Ⅰ型呼衰，痰蒙神窍证
B. Ⅱ型呼衰，痰蒙神窍证
C. Ⅰ型呼衰，脾肾阳虚证
D. Ⅱ型呼衰，脾肾阳虚证
E. Ⅱ型呼衰，痰浊阻肺证

正确答案：B。Ⅱ型呼衰，痰蒙神窍证

解析：平素多湿多痰，恼怒气逆，痰随气升，上闭清窍，故见神志恍惚，谵语，烦躁不安，嗜睡，颜面发绀；舌紫暗，舌苔白腻，脉滑数均为痰热壅盛之侯，故可诊断为痰蒙神窍证。动脉血氧分压＜60mmHg，并伴有二氧化碳分压＞50mmHg，并排除心内解剖分流和原发于心排出量降低等因素，可诊为Ⅱ型呼吸衰竭（B对）。I型呼衰表现为动脉血氧分压＜60mmHg，并伴有二氧化碳分压不变（A错）（C错）。脾肾阳虚证（D错）的特点为咳喘，心悸怔忡，不能平卧，动则尤甚，腹部胀满，浮肿，肢冷尿少，面青唇绀，舌胖紫暗。痰浊阻肺证（E错）的特点为呼吸急促，喉中痰鸣，痰涎粘稠，不易咯出，胸中窒息，面色暗红或青紫，唇舌紫暗。